肉类经烹调后，含量变化不大但有利于消化吸收的营养素是
A. 维生素A
B. B族维生素
C. 维生素C
D. 维生素D
E. 蛋白质

正确答案：E。蛋白质

解析：本题考查肉类经烹调后，含量变化不大但有利于消化吸收的营养素。肉类在烹调过程中，蛋白质含量变化不大，而且经烹调后，蛋白质（E对ABCD错）变性更有利于消化吸收。